某女，15岁。1月前因急性阑尾炎而住院手术治疗，刀口愈合良好。出院后出现便秘，4至5日排便1次。服通便西药乏效遂来求治，刻下除便秘外，又见食欲不佳，脘腹胀满，口干口苦饮水多，喜食凉酸之物，乏力，月经正常，舌红，苔薄白、微腻，脉滑数。证属热结便秘气滞湿阻。治以泻热通肠行气化湿。药用制大黄10g，枳实10g，瓜蒌30g，郁李仁12g（打碎），佩兰10g，陈皮10g，炒神曲12g，生白术10g。3剂，每日1剂水煎服。忌食辛辣油腻宜多食蔬菜。二诊，大便仍干，3日1行。纳增，脘胀减，食后嗳气，口微苦而干，舌红苔薄黄腻，脉弦滑。原方改制大黄为生大黄10g（后下），去郁李仁、炒神曲，加决明子30g（打碎），厚朴6g，炒莱菔子12g（打碎），清半夏10g，续进3剂。三诊，大便通畅，口苦除，仍脘腹胀满，纳欠佳，乏力。治则调整为健脾，行气开胃。原方去生大黄、瓜蒌、厚朴，加太子参15g，茯苓15g，鸡内金10g，续进7剂。其中，投用鸡内金是因其功效是
A. 健脾消食
B. 降气消食
C. 运脾消食
D. 醒脾消食
E. 温脾消食

正确答案：C。运脾消食

解析：本题考查的是鸡内金的功效。投用鸡内金是因其功效是运脾消食（C对）。鸡内金：【功效】运脾消食，固精止遗，化坚消石。木香：【功效】行气止痛，健脾消食（A错）。莱菔子：【功效】消食除胀，降气（B错）化痰。刘寄奴：【功效】破血通经，散寒止痛，消食化积。刘寄奴入脾经，能醒脾开胃而消食（D错）化积，食积泻痢者宜用。功效为温脾消食（E错）的中药，2022年考试指南未明确说明。